肉豆蔻在四神丸中的作用是
A. 温肾暖脾
B. 温肾纳气
C. 温通经脉
D. 温肾暖肝
E. 温脾暖胃

正确答案：E。温脾暖胃

解析：肉豆蔻的功效为温中行气，涩肠止泻。四神丸以补骨脂为君，重在温补命门之火；臣以肉豆蔻，温脾暖胃，涩肠止泻（E对）；佐以吴茱萸温暧脾胃肾以散阴寒，五味子温敛收涩，固肾益气，涩肠止泻，诸药配伍，共奏温肾暖脾（为主），兼涩肠止泻之功，主治脾肾阳虚之五更泻。